易引起下颌骨升支部的边缘性骨髓炎的间隙感染是
A. 颞下间隙感染
B. 眶下间隙感染
C. 翼下颌间隙感染
D. 咬肌间隙感染
E. 下颌下间隙感染

正确答案：D。咬肌间隙感染

解析：咬肌间隙感染的典型症状是以下颌支及下颌角为中心的咬肌区肿胀、充血、压痛，伴明显开口受限。由于咬肌肥厚坚实，脓肿难以自行溃破，也不易触到波动感。若炎症在一周以下，压痛点局限或有凹陷性水肿，经穿刺有脓液时，应行切开引流，否则由于长期脓液蓄积，易形成下颌骨升支部的边缘性骨髓炎。掌握“下颌下间隙、颊间隙感染”知识点。